某男，30岁，居处潮湿，长夏发病，诊断为湿温潮热，其发热特征是
A. 午后发热，五心烦热
B. 午后热甚，身热不扬
C. 日晡热甚，腹痛便结
D. 长期低热，劳倦则甚
E. 发热烦渴，汗多脉洪

正确答案：B。午后热甚，身热不扬

解析：本题考查的是但热不寒的临床意义。湿温潮热的发热特征是午后热甚，身热不扬（B对）。但热不寒的临床意义：但热不寒指的是在疾病过程中，患者唯感有热而没有寒象，同时怕热，此类症状多属热证的表现。发热不恶寒而但恶热，临床常见有以下几种情况：（1）壮热：壮热，指患者高热不退、不恶寒反恶热，称为壮热。多见于风寒入里化热，或风热内传的里实热证。正盛邪实，里热炽盛，蒸达于外，故热势鸱张，此即所谓“阳盛则热”。常兼有多汗、烦渴（E错）等症。（2）潮热：潮热，指发热如潮有定时、按时而发或按时而热更甚的（一般多在下午），即为潮热。临床常见有三种情况：①阴虚潮热：每当午后或入夜即发热，属于“阴虚生内热”，且以五心烦热（A错）为特征，甚至有热自深层向外透发的感觉，故又称“骨蒸潮热”。常兼见盗汗、颧赤、口咽干燥、舌红少津等症。②湿温潮热：以午后热甚、身热不扬为特征。其病多在脾胃，因湿遏热伏，热难透达，所以身热不扬，初扪之不觉很热，扪之稍久则觉灼手。多伴有胸闷呕恶、头身困重、大便溏薄，苔腻等症。③阳明潮热：是由于胃肠燥热内结所致，因其常于日晡阳明旺时而热甚，故又称“日晡潮热”，常兼见腹满痛拒按、大便燥结（C错）、手足汗出、舌苔黄燥、甚则生芒刺等症。（3）长期低热：长期低热，指发热日期较长，而热度仅较正常体温稍高（一般不超过38℃），或仅患者自觉发热而体温并不高者。长期低热的病机比较复杂。例如上述阴虚潮热或暑夏季节的发热，即所谓“疰夏”，可能表现为长期低热不止。这里主要介绍由于气虚引起的长期低热，称为“气虚发热”。气虚发热，除表现为发热日久不止和热度不高以外，还可见面色白、食少乏力、短气懒言、劳倦则甚（D错）、舌淡、脉虚弱等症。多因脾气虚损，中气下陷，清阳不升，郁而为热。